患者，男，40岁。患再生障碍性贫血。面色苍白，唇甲色淡，头晕，心悸，乏力，动则加剧，舌淡，脉细弱。治疗应首先考虑的方剂是
A. 右归丸合当归补血汤
B. 左归丸、右归丸合当归补血汤
C. 八珍汤
D. 六味地黄丸合桃红四物汤
E. 左归丸合当归补血汤

正确答案：C。八珍汤

解析：患者患有再生障碍性贫血，血虚不能荣养肌肤故见面色苍白，唇甲色淡；气血不能上承则头晕；血不养心故见心悸；气虚则乏力，动则加剧；舌淡，脉细弱均为气血两虚的表现。治法为补益气血，方药选用八珍汤加减（C对）。右归丸合当归补血汤（A错）可以补肾助阳，益气养血，用于治疗再生障碍性贫血肾阳虚证。左归丸、右归丸合当归补血汤（B错）可以滋阴助阳，益气补血，用于治疗再生障碍性贫血肾阴阳两虚证。六味地黄丸合桃红四物汤（D错）可以补肾活血，用于治疗再生障碍性贫血肾虚血瘀证。左归丸合当归补血汤（E错）可以滋阴补肾，益气养血，用于治疗再生障碍性贫血肾阴虚证。